C18:0是
A. 单不饱和脂肪酸
B. 多不饱和脂肪酸
C. 饱和脂肪酸
D. 类脂
E. 反式脂肪酸

正确答案：C。饱和脂肪酸